改造奎宁结构得到的磷酸氯喹属于
A. 喹啉醇类药物
B. 氨基喹啉类药物
C. 磺胺类药物
D. 二氨基嘧啶类药物
E. 青蒿素类药物

正确答案：B。氨基喹啉类药物